某男，65岁。哮喘10余年，气短乏力，痰多清稀，食纳减少，腹胀便溏，足面浮肿。舌淡苔白，脉细弱。辨证要点是既有咳喘、纳少，又兼见
A. 气虚
B. 气滞
C. 血虚
D. 阴虚
E. 阳虚

正确答案：A。气虚

解析：本题考查的是肺脾两虚证的辨证要点。哮喘10余年，气短乏力，痰多清稀，食纳减少，腹胀便溏，足面浮肿。舌淡苔白，脉细弱。辨证要点是既有咳喘、纳少，又兼见气虚（A对）。肺脾两虚证的临床表现及辨证要点：肺脾两虚证的临床表现，常见久咳不已，短气乏力，痰多清稀，食纳减少，腹胀便溏，甚则足面浮肿，舌淡苔白，脉细弱。一般以咳喘、纳少、腹胀便溏为主，伴见气虚症状为辨证要点。